诊断慢性活动性肝炎最有参考价值的肝功能检查是哪一项
A. 丙氨酸转氨酶升高
B. 血清碱性磷酸酶升高
C. γ-球蛋白明显升高
D. 凝血酶原时间延长
E. γ-谷氨酸转氨酶升高

正确答案：A。丙氨酸转氨酶升高

解析：血清碱性磷酸酶升高（B错）、γ-球蛋白明显升高（C错）、凝血酶原时间延长（D错）、γ-谷氨酸转氨酶升高（E错）均对慢性肝炎诊断有参考价值，丙氨酸转氨酶（A对）是目前临床上反映肝细胞功能的最常用的指标，参考意义最大。